治疗虚寒痢应首选
A. 胃苓汤
B. 连理汤
C. 芍药汤
D. 桃花汤
E. 驻车丸

正确答案：D。桃花汤

解析：虚寒痢是由于脾肾阳虚，寒湿内生，寒湿阻滞于肠道而致，治疗应温补脾肾，收涩固脱，代表方为桃花汤合真人养脏汤（D对）。胃苓汤，其功用为通阳利水，燥湿运脾，适用于痢疾之寒湿痢（A错）。连理汤，其功用为温中补脾兼清湿热的作用，适用于痢疾之休息痢(B错)。芍药汤，其功用为调气行血，清热解毒，适用于痢疾之湿热痢（C错）。驻车丸，其功用为坚阴养血，清热化湿的作用，适用于痢疾之阴虚痢（E错）。